脊神经根阻滞术，常选的部位在
A. 硬膜外隙
B. 硬膜与蛛网膜之间
C. 蛛网膜下腔
D. 脊膜与脊髓之间
E. 以上都不是

正确答案：A。硬膜外隙

解析：硬膜外隙（A对）（硬脊膜与椎管内面的骨膜之间的间隙）是脊神经根阻滞术的常选部位。